药物扩散速度取决于膜两侧药物的浓度梯度、药物的脂水分配系数及药物在膜内扩散速度的药物转运方式是
A. 主动转运
B. 简单扩散
C. 易化扩散
D. 膜动转运
E. 滤过

正确答案：B。简单扩散

解析：本题考查药物的转运方式。简单扩散（B对）为被动转运，其药物的扩散速度取决于膜两侧药物的浓度梯度、药物的脂水分配系数及药物在膜内的扩散速度；主动转运（A错）为逆浓度梯度运输的过程；易化扩散（C错）是需要借助载体的被动运输；膜动转运（D错）是细胞膜通过主动变形将某些物质摄入细胞内或从细胞内释放到细胞外的过程；滤过（E错）是指水溶性小分子物质依靠膜两侧的流体静压或渗透压通过孔道的过程。